以“补血而不滞血，行血而不伤血”为配伍特点的方剂是
A. 四物汤
B. 归脾汤
C. 炙甘草汤
D. 补中益气汤
E. 当归补血汤

正确答案：A。四物汤

解析：“补血而不滞血”，说明在补血的同时兼顾活血；“行血而不伤血”，说明在活血的同时兼顾补血。故以“补血而不滞血，行血而不伤血”为配伍特点的方剂，即养血活血的方剂。四物汤中以熟地、白芍阴柔补血之品（血中血药）与补血活血之当归、活血行气之川芎（血中气药）相配，动静相宜，补血而不滞血，行血而不伤血，温而不燥，滋而不腻，成为补血调血之良方（A对）。归脾汤的配伍特点是心脾同治、气血并补（但重在补气）、补而不滞（补气养血药中佐以木香理气醒脾）（B错）。炙甘草汤滋而不腻，温而不燥，使气血充足，阴阳调和，则心动悸、脉结代，皆得其平（C错）。补中益气汤使气虚得补，气陷得升（D错）。当归补血汤补气生血（E错）。